单胺氧化酶抑制剂+氯丙嗪治疗紧张和烦躁属于
A. 提高药物疗效
B. 减少不良反应
C. 治疗多种疾病
D. 延缓细菌耐药性的产生
E. 加速细菌胞壁破裂

正确答案：A。提高药物疗效